患儿，2岁。发热，体温38℃，鼻塞流涕，咳嗽，皮疹初现，疹色红润，点粒稀疏，躯干为多，多为丘疹，少数疱疹，舌苔薄白，精神尚可。其治法是
A. 疏风宣肺止咳
B. 疏风清热解毒
C. 辛凉解表透疹
D. 辛温宣肺透疹
E. 清热凉营解毒

正确答案：B。疏风清热解毒

解析：患儿皮疹多为丘疹，少数疱疹，可判断为水痘，鼻塞流涕，咳嗽，皮疹初现，疹色红润，点粒稀疏，躯干为多，苔薄白，精神尚可，诊断为邪伤肺卫证。治法为疏风清热，利湿解毒。（B对）（ACDE错）。